治疗产后发热感染邪毒证，应首选
A. 小柴胡汤
B. 大柴胡汤
C. 桃红消瘀汤
D. 白虎汤
E. 解毒活血汤

正确答案：E。解毒活血汤

解析：产后发热外感证若邪入少阳，症见寒热往来、口苦、咽干、目眩、默默不欲饮食，脉弦者，治宜和解少阳，方选小柴胡汤（A错）。大柴胡汤功能和解少阳，内泻热结，主治少阳阳明合病（B错）。桃红消瘀汤功能活血祛瘀，可用于治疗产后恶露不绝（C错）。产后发热感染邪毒证若高热不退，大汗出，烦渴引饮，脉虚大而数者，属热盛伤津之候，治宜清热除烦，益气生津，方选白虎汤加人参，即白虎人参汤（D错）。产后发热感染邪毒证治宜清热解毒，凉血化瘀，方选五味消毒饮或解毒活血汤（E对）。